下列哪项为环境中常见的二次污染物
A. SO₂和NOₓ
B. 二噁英和甲基汞
C. 甲基汞和光化学烟雾
D. NOₓ和酸雨
E. 多环芳烃和二噁英

正确答案：C。甲基汞和光化学烟雾

解析：本题考查二次污染物。二次污染物是指某些一次污染物进入环境后在物理、化学或生物学作用下，或与其他物质发生反应而形成与初始污染物的理化性质和毒性完全不同的新的污染物。环境中常见的二次污染物有甲基汞和光化学烟雾（C对ABDE错）。甲基汞是一种有毒的重金属，它可以通过大气中的气体和悬浮物进入环境，并且它的毒性很强，可以对人体和生态系统造成严重的污染。光化学烟雾主要是由于汽车废气中的氮氧化物（NOₓ）和挥发性有机物在强烈的太阳紫外线照射下经过一系列化学反应而形成的，其成分复杂，包括臭氧、过氧酰基硝酸酯（PANs）和醛类等多种成分。